易引起直立性低血压的药物是
A. 多沙唑嗪
B. 赖诺普利
C. 羟考酮
D. 辛伐他汀
E. 氨氯地平

正确答案：A。多沙唑嗪

解析：本题考查药物的不良反应。易引起直立性低血压的药物是多沙唑嗪（A对）。赖诺普利（B错）常见不良反应有：轻微且短暂的头痛、眩晕、疲乏、嗜睡、恶心、咳嗽。羟考酮（C错）不良反应有便秘、恶心、呕吐、头晕等。辛伐他汀（D错）典型的不良反应是横纹肌溶解症。氨氯地平（E错）常见的不良反应为足踝部水肿。